某一酸碱指示剂的pKIn=3.4，它的变色范围应是
A. 2.4～3.4
B. 2.4～4.4
C. 4.4～6.2
D. 6.2～7.6
E. 1.9～4.9

正确答案：B。2.4～4.4